原始口腔在第4周时是由以下哪组突起形成的
A. 上颌突、下颌突和额鼻突
B. 中鼻突、侧鼻突和上颌突
C. 中鼻突、侧鼻突和下颌突
D. 球状突、侧鼻突和上颌突
E. 球状突、上颌突和下颌突

正确答案：A。上颌突、下颌突和额鼻突

解析：约在胚胎24天，第1鳃弓上出现了另一个突起即上颌突。此时原口界限是上有迅速增大的额鼻突、下有第1鳃弓（此时称下颌突），两侧为上颌突。口凹与前肠之间有口咽膜开始破裂，口腔与前肠相通。掌握“面部的发育”知识点。